男，42岁，劳累性胸闷，心悸1年，晕厥一次，既往无高血压病史和糖尿病病史，有类似家族史，查体：血压120/80mmhg，心率80次/分，胸骨左缘三四肋间可闻及4/6级收缩期喷射样杂音，心尖部听诊区可闻及3/6级收缩期杂音。以下诊断正确的是
A. 梗阻性肥厚型心肌病
B. 扩张型心肌病
C. 风湿性心脏瓣膜病
D. 冠状动脉粥样硬化性心脏病
E. 室间隔缺损

正确答案：A。梗阻性肥厚型心肌病

解析：患者中年男性，劳累后胸闷、心悸，有类似家族史（肥厚型心肌病是一种遗传性心肌病），胸骨左缘三四肋间可闻及4/6级收缩期喷射样杂音（提示流出道梗阻），心尖部听诊区可闻及3/6级收缩期杂音（二尖瓣前叶移向室间隔导致二尖瓣关闭不全），综合患者的病史、症状、体征，最可能的诊断是肥厚型心肌病（A对）。扩张型心肌病（B错）临床主要表现为充血性心力衰竭，主要体征为心界扩大，常可闻及第三或第四心音，有时可于心尖部闻及收缩期杂音。室间隔缺损（E错）可有胸骨左缘第3～4肋间Ⅳ～Ⅵ全收缩期杂音。风湿性心脏病（C错）患者多有风湿热病史，且多在年幼时发病，并伴有相应瓣膜区的改变。冠心病（D错）指冠状动脉发生粥样硬化引起管腔狭窄或闭塞，导致心肌缺血缺氧或坏死，多见于40岁以上中、老年人，急剧的、暂时的缺血缺氧引起心绞痛，无胸骨左缘三四肋间4/6级收缩期喷射样杂音。